《中国药典》一部中性状的基本内容
A. 性状与大小
B. 色泽与表面
C. 质地与断面
D. 气、味
E. 杂质和水分

正确答案：A、B、C、D。性状与大小；色泽与表面；质地与断面；气、味

解析：本题考查的是《中国药典》基本内容。《中国药典》一部中性状的基本内容性状与大小（A对）、色泽与表面（B对）、质地与断面（C对）、气、味（D对）。中药的真实性鉴定的性状鉴别包括：药材的形状，大小，色泽，表面特征，质地，断面，气，味，水试，火试。